判断饮用水是否受粪便污染的重要微生物指标是
A. 菌落总数
B. 总大肠菌群
C. 耐热大肠菌群
D. 大肠埃希氏菌
E. 隐孢子虫

正确答案：D。大肠埃希氏菌

解析：本题考查判断饮用水是否受粪便污染的重要微生物指标。大肠埃希菌（D对ABCE错）习惯称为大肠杆菌，存在于人和动物的肠道中，在自然界中生命力很强，能在土壤、水中存活数月，是判断饮用水是否遭受粪便污染的重要微生物指标。根据《生活饮用水卫生标准》（GB 5749-2022），微生物指标中已删除耐热大肠菌群。